慢性根尖周炎在进行根管预备时，使用大量过氧化氢液冲洗根管，2小时后相应面颊迅速肿胀，无疼痛感，触诊时有捻发音，此时应如何处理
A. 静脉滴注防止感染扩散
B. 局部切开缓解肿胀
C. 去除暂封，大量生理盐水冲洗根管
D. 不需特殊处理，可给予抗生素防止感染
E. 局部加压包扎

正确答案：D。不需特殊处理，可给予抗生素防止感染

解析：本题考查根管冲洗。慢性根尖周炎在进行根管预备时，使用大量过氧化氢液冲洗根管，2小时后相应面颊迅速肿胀，无疼痛感，触诊时有捻发音，此时应不需特殊处理，可给予抗生素防止感染（D对）。根管冲洗过程中应避免发生以下问题：①疼痛：3%过氧化氢液对根尖周组织有轻度刺激，冲洗后要吸干，防止遗留分解氧气压迫根尖周组织而致痛。②气肿：过氧化氢液通过根尖孔偶引发皮下气肿。使用时要小心，冲洗根管时，不要卡紧和加压推注。③针头误吞：冲洗根管时因压力脱落，针头不慎会吞入食管或气管。吞入消化道者大多可从粪便排出，进入气管则后果严重。因此当使用过氧化氢溶液冲洗根管时，若出现题干提及的情况，可通过给予抗生素防止感染。